任脉的主治特点是
A. 肝、脾、肾病
B. 回阳、固脱、强壮作用
C. 后头、肩胛病，神志病
D. 中风、昏迷、热病、头面病
E. 前头、口齿、咽喉病，胃肠病学

正确答案：B。回阳、固脱、强壮作用

解析：任脉总司一身阴经气血，是“阴脉之海”，具有回阳、固脱，有强壮作用（B对），主治脏腑病、妇科病、前阴病、颈及口面病、神志病、虚证。